男孩，4岁。生长落后，活动后气促。查体：胸骨左缘第2～3肋间有3/6级收缩期杂音，P₂亢进。X线片示右心房右心室扩大。目前最佳的治疗方案是
A. 口服拉托普利
B. 随访观察
C. 防止感染
D. 手术修补
E. 口服吲哚美辛

正确答案：D。手术修补

解析：患儿，胸骨左缘第2-3肋间有3-6级收缩期杂音，P2亢进，另外X线片示右心房右心室扩大，符合房间隔缺损的特征，应诊断为房间隔缺损。针对类似房间隔缺损的解剖结构性改变，动脉导管未闭是先心病中唯一可以用药物吲哚美辛治愈的（E错），其余的最佳治疗方案是手术修补（D对）。拉托普利是高血压用药（A错）。患儿症状不严重时可以采取随访观察的方案，但此患儿已有生长落后和活动后气促的症状，应尽快手术，而不是随访观察（B错）。防止感染并不是关键的治疗，只是一般的治疗（C错）。